疼痛而皮色不红、不热，得暖则痛缓。其痛的原因是
A. 热
B. 寒
C. 风
D. 气
E. 虚

正确答案：B。寒

解析：掌握疼痛的特点，应从引起疼痛的原因、发作情况、疼痛性质等几方面进行辨证。寒为阴邪，易伤阳气，其性主收引，寒胜则痛，故见四肢拘挛疼痛，患部皮色不红，皮温低，痛有定处，得热则减（B对）。热痛表现为皮色焮红，灼热疼痛，遇冷则痛减（A错）。风痛表现为痛无定处，忽彼忽此，走注甚速，遇风则剧（C错）。气痛表现为攻痛无常，时感抽掣，喜缓怒甚（D错）。虚痛表现为喜按，按则痛减（E错）。